心血虚与心阴虚共见症状是
A. 失眠
B. 脉细数
C. 舌淡
D. 心烦
E. 盗汗

正确答案：A。失眠

解析：心血虚证是由于血液亏虚，心失濡养所致；心神失养，神不守舍，则会出现失眠。心阴虚证是由于阴液亏损，心是滋养，虚热内扰所致；虚热内扰，神不守舍，则会出现失眠（A对）。